药物的副作用是指
A. 治疗量时出现的与用药目的无关的作用
B. 用量过大或用药时间过长出现的对机体有害的作用
C. 继发于治疗作用后出现的一种不良后果
D. 与剂量无关的一种病理性免疫反应
E. 停药后血药浓度降至阈浓度以下时出现

正确答案：A。治疗量时出现的与用药目的无关的作用

解析：药物的副作用是在治疗剂量时产生的与治疗目的无关的作用（A对），例如，阿托品用于解除胃肠道痉挛时，可引起口干、心悸、便秘等副作用。用量过大或用药时间过长出现的对机体有害的作用（B错）（P22）是指毒性反应，一般比较严重。继发于治疗作用后出现的一种不良后果（C错）指的是继发反应。与剂量无关的一种病理性免疫反应（D错）（P22）指的是变态反应。停药后血药浓度降至阈浓度以下时出现（E错）（P22）指的是后遗效应。